机械性肠梗阻的典型表现是
A. 板状腹
B. 阵发性腹痛
C. 膈下游离气体
D. X光检查阶梯样液平面
E. 肠鸣音减弱

正确答案：D。X光检查阶梯样液平面

解析：机械性肠梗阻多因肠道内、外或肠壁本身的各种器质性病变或其他因素使肠腔变小，肠腔内容物通过受阻所致，典型表现是X光检查阶梯样液平面（D对）。板状腹说明患者上消化道穿孔（A错）。阵发性腹痛是可引起肝、胆、胰、胃、肠、输尿管的疼痛（B错）。膈下游离气体多为胃或十二指肠溃疡穿孔所致（C错）。肠鸣音减弱见于老年性便秘、腹膜炎、电解质紊乱（低血钾）、胃肠动力低下等（E错）。